反映肝硬化肝功能减退的血清指标是
A. 丙氨酸氨基转移酶
B. 碱性磷酸酶
C. 谷氨酸氨基转移酶
D. 白蛋白
E. 甲胎蛋白

正确答案：D。白蛋白

解析：除γ球蛋白、vW因子以外的大多数血浆蛋白，如白蛋白、糖蛋白、脂蛋白、多种凝血因子、抗凝因子、纤溶因子及各种转运蛋白等均在肝脏合成。肝硬化肝功能减退后，合成功能下降，上述血浆蛋白质合成减少，尤其是白蛋白（D对）减少，导致低白蛋白血症。丙氨酸氨基转移酶（A错）和谷氨酸氨基转移酶（C错）是反映肝细胞膜通透性的指标，当肝细胞受损时，肝细胞膜通透性增高，导致血清浓度升高。碱性磷酸酶（B错）是反映肝脏胆汁是否排出受阻的指标。甲胎蛋白（E错）是诊断肝细胞癌特异性的标志物。